混合唾液中固体物质约占
A. 0.002
B. 0.004
C. 0.006
D. 0.008
E. 0.01

正确答案：C。0.006

解析：唾液中水分约占99.4%，固体物质约占0.6%（其中有机物约占0.4%，无机物约占0.2%）。掌握“唾液的分泌和功能”知识点。